血浆的pH值主要取决于下列哪个缓冲对
A. KHCO₃/H₂CO₃
B. K₂HPO4/KH₂PO₄
C. NaHCO₃/H₂CO₃
D. Na₂HPO₄/NaH₂PO₄
E. Na-蛋白质/H-蛋白质

正确答案：C。NaHCO₃/H₂CO₃